药品零售连锁企业可以通过网络销售的是
A. 米非司酮片
B. 阿昔洛韦乳膏
C. 可待因
D. 氨酚伪麻美芬片Ⅱ

正确答案：B。阿昔洛韦乳膏

解析：本题考查网络药品经营管理。向个人消费者提供互联网药品交易服务的企业只能在网上销售本企业经营的非处方药，如阿昔洛韦乳膏（B对）。疫苗、血液制品、麻醉药品、精神药品、医疗用毒性药品、放射性药品、药品类易制毒化学品等国家实行特殊管理的药品不得在网上销售。